女，40岁。右乳外上象限无痛性肿块，直径4cm，与皮肤轻度粘连，右腋下可触及一枚可推动淋巴结，检查未发现远处转移征象，诊断为“乳腺癌”，按TNM分期应为
A. T₁N₁M₀
B. T₁N₀M₀
C. T₂N₁M₀
D. T₂N₀M₀
E. T₁N₂M₃

正确答案：C。T₂N₁M₀

解析：该患者原发癌瘤直径4cm，属于T2（癌瘤长径＞2cm，≤5cm），同侧腋下可触及一枚可推动淋巴结，属于N1（同侧腋窝有肿大淋巴结，尚可推动），检查未发现远处转移征象，属于M0（无远处转移），所以本题TNM分期应为T2N1M0（C对）。